男，35岁。腹泻、腹痛伴低热、乏力、盗汗2个月。查体：右下腹可触及包块，压痛（+），边界不清。结肠镜发现回盲部环形溃疡。最可能的诊断是
A. 溃疡性结肠炎
B. 结肠癌
C. 克罗恩病
D. 肠结核
E. 阿米巴肠病

正确答案：D。肠结核

解析：患者低热盗汗2月（结核感染特征性临床表现），内镜下见回盲部黏膜充血、水肿，溃疡，且查体有腹部包块，最可能的诊断是肠结核（P215）（D对）。溃疡性结肠炎（八版内科学P385）（A错）病变主要限于大肠黏膜与黏膜下层，呈连续性、弥漫性分布。结肠癌（B错）通过结肠镜能直接观察全结直肠的肠壁、肠腔的改变，并确定肿瘤的部位、大小，初步判断浸润范围，早期结直肠癌的内镜下形态分为隆起型和平坦型，结合患者年龄，临床表现不考虑结肠癌（八版外科学P402）。克罗恩病（八版内科学P390）（C错）肠镜可见阿弗他溃疡或纵行溃疡，黏膜鹅卵石样改变，肠腔狭窄或肠壁僵硬，炎性息肉等。阿米巴肠病（P274）（E错）可见肠壁大小不等散在性溃疡，中心区有渗出，边缘整齐，周边有一圈红晕。